新生儿溶血疾病换血治疗的指征，血清胆红素在足月儿至少应大于
A. 10mg/dl
B. 15mg/dl
C. 20mg/dl
D. 25mg/dl
E. 30mg/dl

正确答案：C。20mg/dl

解析：新生儿溶血疾病换血治疗指征如下：1.产前已明确诊断，出生时脐血总胆红素＞4mg/dl，血红蛋白低于120g/L，伴水肿、肝脾大和心衰者；2.生后12小时内胆红素每小时上升＞0.7mg/dl者；3.总胆红素已达到20mg/dl者（C对）；4.不论胆红素水平高低，已经有胆红素脑病的早期表现者；5.小早产儿、合并缺氧、酸中毒者或者上一胎溶血严重者应放宽指征。